《医疗机构从业人员行为规范》中“以人为本，践行宗旨”的具体要求不包括
A. 积极维护社会公益，促进人类健康
B. 坚持救死扶伤，防病治病的宗旨
C. 发扬大医精诚理念
D. 以患者为中心，全心全意为人民健康服务
E. 发扬人道主义精神

正确答案：A。积极维护社会公益，促进人类健康

解析：《医疗机构从业人员行为规范》，第二章第四条：以人为本，践行宗旨。坚持救死扶伤、防病治病的宗旨（B对），发扬大医精诚理念（C对）和人道主义精神（E对），以病人为中心，全心全意为人民健康服务（D对）。积极维护社会公益，促进人类健康（A错，为本题正确答案）不属于该要求。